按发病情况和进展速度可将龋病分为
A. 浅龋、中龋、深龋
B. 急性龋、慢性龋、继发龋
C. （牙合）面（窝沟）龋和平滑面龋
D. 牙釉质龋、牙本质龋、牙骨质龋
E. 根面龋和线性牙釉质龋

正确答案：B。急性龋、慢性龋、继发龋

解析：本题考查龋病的分类。按照龋病发病情况和进展速度分类，可分为急性龋、慢性龋、继发龋（B对）。根据病变深度分类可分为浅龋、中龋、深龋（A错）。根据损害的解剖部位分类，分为（牙合）面（窝沟）龋、平滑面龋（C错）、根面龋和线性牙釉质龋（E错）、隐匿性龋。根据龋病累及的组织分类可分为牙釉质龋、牙本质龋、牙骨质龋（D错）。